新生儿，1天。足月顺产，于生后20小时出现黄疸。血清胆红素342umol/L（20mg/dI）。患儿血型为A型，母亲血型为O型。本病最严重的并发症是
A. 酸中毒
B. 水肿
C. 胆红素脑病
D. 硬肿
E. 贫血

正确答案：C。胆红素脑病

解析：患儿于生后20小时出现黄疸，血清胆红素342umol/L（正常≤17.1umol/L，高于正常20倍），提示为病理性黄疸。患儿血型为A型，母亲血型为O型，结合黄疸情况，最可能的诊断为ABO溶血。过高的胆红素血症，未结合胆红素透过血－脑屏障可造成神经系统永久性的损害和功能障碍，因此ABO溶血最严重的并发症是胆红素脑病。